慢性肺心病患者提示右心功能不全的主要体征是
A. 双下肢水肿
B. 肝颈静脉回流征阳性
C. 心脏向左扩大
D. 肺动脉瓣区第二心音（P₂）亢进
E. 肝大，触痛阳性

正确答案：B。肝颈静脉回流征阳性

解析：右心衰竭的病人，如按压其肿大的肝脏时，则颈静脉充盈更为明显，称肝颈静脉回流征阳性。慢性肺心病患者提示右心功能不全的主要体征是肝颈静脉回流征阳性（B对），且具有特征性。而双下肢水肿（A错）、肝大且触痛阳性（E错）虽为右心功能不全的体征，但不是最主要的体征。心脏向左扩大（C错）为肺心病时，右心室扩大的体征。肺动脉瓣区第二心音（九版诊断学P151）亢进为肺动脉高压表现（D错）。